指深屈肌
A. 起自肱骨内上髁
B. 止于第2-4指远节指骨底
C. 位于拇长屈肌桡侧
D. 尺侧有蚓状肌附着
E. 屈远侧指骨间关节

正确答案：E。屈远侧指骨间关节

解析：指深屈肌起自尺骨上端前面，而非肱骨内上髁（A错）；止于第2～5指远节指骨底，而非第2～4指远节指骨底（B错）；位于拇长屈肌尺侧，而非桡侧（C错）；桡侧有蚓状肌附着，而非尺侧（D错）；屈第2～5指远侧指骨间关节（E对）。